确诊高血压性脑出血的最重要的检查是
A. 头颅X线法
B. 测量血压
C. 经颅超声多普勒
D. 脑CT
E. 颈动脉B超

正确答案：D。脑CT